阿托品引起口干及盗汗的剂量
A. 0.5mg
B. 1mg
C. 2mg
D. 5mg
E. 10mg

正确答案：A。0.5mg

解析：0.5mg：心率轻度减慢，略有口干及盗汗。掌握“阿托品”知识点。